口呼吸最易引发的牙龈炎是
A. 增生性龈炎
B. 慢性龈缘炎
C. 妊娠期龈炎
D. 遗传性牙龈纤维瘤病
E. 牙龈瘤

正确答案：A。增生性龈炎

解析：本题考查牙周病的局部促进因素-不良习惯-口呼吸。口呼吸患者常兼有上唇过短，上前牙牙龈外露，患牙龈炎和牙龈肥大的机会较大，表现为增生性龈炎（A对），有很多患者的增生区是以唇线为明确界限的。慢性龈缘炎（B错）是由菌斑堆积引起的，不是由口呼吸引发的。妊娠期龈炎（C错）的直接病因为菌斑微生物，全身促进因素为孕期雌激素水平的升高。遗传性牙龈纤维瘤病（D错）牙龈增生较重甚至覆盖整个牙面，至今病因不明，多有家族史，不是由口呼吸引发的。牙龈瘤（E错）是来源于牙周膜及牙龈结缔组织的炎症反应性瘤样增生物，主要与菌斑、牙石等局部刺激因素及内分泌改变有关，与口呼吸关联不大。